患者，女，20岁。末次月经如期来潮，5天干净，7天后阴道再次出血，开始5天量极多，色深红，质稠，今日量稍减，口渴烦热，纳少，大便干，舌苔黄，脉滑数。其治法是
A. 滋阴清热，止血调经
B. 清热凉血，止血调经
C. 滋水益阴，止血调经
D. 凉血化瘀，止血调经
E. 清热固冲，止血调经

正确答案：B。清热凉血，止血调经

解析：患者本次月经结束之后再次阴道出血，为经间期出血。且色深红，质稠，口渴烦热，纳少，大便干均为血热的表现；舌苔黄，脉滑数为实热之象。故治疗时要清热凉血，止血调经（B对）。滋阴清热，止血调经常用于有阴虚内热证候表现的经间期出血证（A错）。滋水益阴，止血调经多用于肾阴虚证（C错）。凉血化瘀，止血调经多用于因为血热出血证的经间期出血（D错）。清热固冲，止血调经用于湿热出血证的经间期出血（E错）。